停经3月余，子宫40天妊娠大小
A. 流产感染
B. 稽留流产
C. 先兆流产
D. 难免流产
E. 不全流产

正确答案：B。稽留流产

解析：稽留流产：亦称过期流产或死胎不下。系指胚胎死亡而仍稽留于宫腔内者，且孕产物一般多在症状产生后1～2个月内排出。因此，皆规定胚胎停止发育后2个月尚未自然排出者，称为稽留流产。孕妇多有早期妊娠先兆流产经过，此后子宫不再长大，反渐缩小，且亦不像一般妊娠那样柔软。掌握“自然流产”知识点。